下列哪项不是血浆蛋白的主要功能
A. 运输物质
B. 参与机体的免疫
C. 缓冲pH值
D. 参与生理止血
E. 维持血浆晶体渗透压

正确答案：E。维持血浆晶体渗透压